除烦利尿的药物是
A. 夏枯草
B. 天花粉
C. 淡竹叶
D. 知母
E. 苦参

正确答案：C。淡竹叶

解析：以上选项均是清热药。淡竹叶甘、淡，寒；入心、胃、小肠经。能清心火以除烦，甘淡能渗血利尿（C对）。夏枯草辛、苦，寒；入肝、胆经。可清泻肝火以明目；辛以散结，治疗瘿瘤、瘰疬、乳痈等（A错）。天花粉甘、微苦，微寒；入肺、胃经。既能清肺胃二经实热，又能生津止渴，可消肿排脓疗疮（B错）。知母苦、甘，寒；入肺、胃、肾经。苦寒能清热泻火除烦，甘寒能生津润燥止渴（D错），治疗外感热病，高热烦渴；肺热咳嗽，阴虚燥咳；骨蒸潮热；内热消渴；肠燥便秘。苦参苦，寒；入心、肝、胃、大肠、膀胱经，可利尿无除烦的功效（E错）。